提示原发型肺结核病变恶化的病理转归是
A. 结核性胸膜炎
B. 原发病灶扩大，产生空洞
C. 支气管淋巴结肿大
D. 支气管淋巴结周围炎
E. 急性粟粒性肺结核

正确答案：E。急性粟粒性肺结核

解析：原发型肺结核多见于少年儿童，X线胸片表现为哑铃型阴影，即原发病灶、引流淋巴管炎和肿大的肺门淋巴结，形成典型的原发综合征。原发病灶一般吸收较快，可不留任何痕迹。若原发型肺结核病灶继续扩大，可发展为急性血行播散型肺结核，即急性粟粒型肺结核（E对），X线胸片和CT检查开始为肺纹理重，在症状出现两周左右可发现由肺尖至肺底呈大小、密度和分布三均匀的粟粒状结节阴影，提示病变恶化。原发病灶扩大，产生空洞（B错）、支气管淋巴结肿大（C错）都是肺结核病变加重的表现，但并不转化为另一种类型。结核性胸膜炎（A错）是结核杆菌及其自溶产物、代谢产物进入胸膜腔而引起的胸膜炎症，属肺外结核病，并不是原发型肺结核病变恶化的病理转归。肺结核一般不会发展为支气管淋巴结周围炎（D错），其多由病毒、细菌直接感染引起，也可由上呼吸道细菌或病毒蔓延引起。